下列哪项不是清热调血汤的组成药物
A. 当归、川芎、白芍、生地
B. 元胡、香附
C. 黄柏
D. 桃仁、红花、莪术、丹皮
E. 黄连

正确答案：C。黄柏

解析：清热调血汤在妇科中可治疗痛经湿热瘀阻证，由牡丹皮、黄连、生地黄、当归、白芍、川芎、红花、桃仁、元胡、莪术、香附组成，不包含黄柏（C错，为本题正确答案）。方歌：清热凉血黄连丹，归芍芎地桃红参，延胡莪术香附入，清热除湿止痛安。